用人单位有下列哪种情节严重的行为，卫生行政部门可以责令停止产业职业病危害的作业
A. 订立或者变更劳动合同时，未告知劳动者职业病危害真实情况的
B. 未按照规定及时，如实向卫生行政部门申报产生职业病危害的项目的
C. 工作场所职业病危害因素的强度或者浓度超过国家职业卫生标准
D. 未按照规定报告职业病，疑似职业病的
E. 拒不承担疑似职业病患者在诊断、医学观察期间的费用的

正确答案：C。工作场所职业病危害因素的强度或者浓度超过国家职业卫生标准